患者，女，31岁。崩漏下血量多，色暗红，质稠，夹有血块，腹痛拒按，舌红苔黄，脉弦数。治疗应首选
A. 阴陵泉
B. 中极
C. 三阴交
D. 太冲
E. 隐白

正确答案：E。隐白

解析：患者，女，31岁。崩漏下血量多，色暗红，质稠，夹有血块，腹痛拒按，舌红苔黄，脉弦数。当辩证为崩漏实证，血热证。治法调理冲任，固崩止漏。以任脉及足太阴经穴为主，基础穴位为关元、三阴交、隐白。患者此时血量较多，为崩漏急症，按照急则治其标的原则，当以止血为主，隐白（E对）为足太阴经井穴，可健脾统血，是治疗崩漏的经验穴，隐白穴多灸，可以快速止血。